下列可作为透皮吸收促进剂的是
A. 尿素
B. 氰基丙烯酸烷酯
C. 两者均可
D. 两者均不可

正确答案：A。尿素

解析：本题考查栓剂的附加剂。尿素（A对）可作为透皮吸收促进剂；氰基丙烯酸烷酯不能用作透皮吸收促进剂（BCD错）。